无机砷是确定的人类致癌物，其引起的肿瘤最常发生在
A. 肝
B. 脑
C. 骨骼
D. 肺
E. 皮肤

正确答案：E。皮肤

解析：本题考查无机砷引起肿瘤的部位。无机砷是一种常见的有毒物质，它可以通过空气、水和食物传播到环境中，并可能通过皮肤接触来暴露人类。无机砷是一种确定的人类致癌物，可以通过皮肤接触、呼吸或食用含砷食物而引起肿瘤，其中最常见的是皮肤（E对ABCD错）癌。